上中切牙近中唇面距离切牙乳头的距离是
A. 5～6mm
B. 6～7mm
C. 7～8mm
D. 8～1Omm
E. 10～12mm

正确答案：D。8～1Omm

解析：本题考查无牙颌的解剖标志-切牙乳突。上中切牙近中唇面距离切牙乳头的距离是8～1Omm（D对）。切牙乳突与上颌中切牙之间有较稳定的位置关系，中切牙唇面位于切牙乳突中点前8～10mm，上颌两侧尖牙牙尖顶的连线通过切牙乳突中点。切牙乳突位置稳定，是全口义齿排列上颌前牙的重要参考标志。随着上颌前部牙槽嵴吸收，牙槽嵴顶位置逐渐靠近切牙乳突。牙槽嵴吸收严重者，切牙乳突可位于牙槽嵴顶。此时，义齿中切牙唇面与切牙乳突的距离应适当缩小，两侧尖牙牙尖连线可位于切牙乳突后缘。